下列不属于农药污染食品主要途径的是
A. 喷洒作物
B. 植物根部吸收
C. 空中随雨雪降落
D. 误食
E. 运输和贮存中混放

正确答案：D。误食